用纱布棉花蘸取后涂搽皮肤口腔或喉部黏膜的液体制剂是
A. 洗剂
B. 搽剂
C. 洗漱剂
D. 灌洗剂
E. 涂剂

正确答案：E。涂剂

解析：本题考查涂剂。涂剂（E对）为用消毒纱布或棉球等柔软物料蘸取涂于皮肤或口腔与喉部黏膜的液体制剂；洗剂（A错）系指原料药物的溶液、乳状液、混悬液，供清洗或涂抹无破损皮肤或腔道用的液体制剂；搽剂（B错）系指原料药物用乙醇、油或适宜的溶剂制成的溶液、乳状液或混悬液，供无破损皮肤揉擦用的液体制剂；洗漱剂（C错）是指专供洗漱用的液体制剂；灌洗剂（D错）用于清洗阴道、尿道的液体制剂。